需要与传染病鉴别时，应特别注意询问的是
A. 预防接种史
B. 生长发育史
C. 喂养史
D. 家族史
E. 胎产史

正确答案：A。预防接种史

解析：需要与传染病鉴别时，应特别注意询问预防接种史，包括曾接种过的疫苗种类、时间和次数，有否不良反应（A对）。生长发育史（B错）为小儿患有神经系统或内分泌系统疾病时应特别注意询问的内容。喂养史（C错）为小儿患有消化系统疾病时应特别注意询问的内容。家族史（D错）为小儿患有具有遗传倾向疾病时应特别注意询问的内容。胎产史（E错）为新生儿期疾病应特别注意询问的内容。